以上哪种疾病的上皮的棘层、基底层或黏膜固有层可见椭圆形或卵圆形的胶样小体
A. 扁平苔藓
B. 红斑
C. 白斑
D. 天疱疮
E. 黏膜下纤维化

正确答案：A。扁平苔藓

解析：本题考查口腔扁平苔藓与慢性盘状红斑狼疮。扁平苔藓（A对）病理表现中，上皮的棘层、基底层或黏膜固有层可见椭圆形或卵圆形的胶样小体或称Civatte小体，均质嗜酸性，PAS染色阳性呈玫瑰红色。这种小体可能是细胞凋亡的一种产物。